分泌女性激素的卵巢肿瘤是
A. 无性细胞瘤
B. 颗粒细胞瘤
C. 畸胎瘤
D. 内胚窦瘤
E. 浆液性囊腺瘤

正确答案：B。颗粒细胞瘤

解析：分泌女性激素（雌激素）的卵巢恶性肿瘤是颗粒细胞瘤（B对）。病理上颗粒细胞瘤分为成人型和幼年型，其中成年型颗粒细胞瘤为低度恶性肿瘤，能分泌雌激素，可引起性早熟、月经紊乱及绝经后阴道不规则流血。畸胎瘤（C错）可分为成熟畸胎瘤和未成熟畸胎瘤，前者偶见向单一胚层分化，形成高度特异性畸胎瘤，如卵巢甲状腺肿，分泌甲状腺激素，后者为恶性肿瘤，无分泌功能；无性细胞瘤（A错）的特点是对放疗敏感；内胚窦瘤（D错）又称卵黄囊瘤，特点是恶性程度高，对化疗敏感，以上三种卵巢肿瘤均属于卵巢生殖细胞肿瘤，无分泌女性激素功能。浆液性囊腺瘤（E错）多为单侧，球形，大小不等，囊性，属于卵巢上皮性肿瘤，无分泌功能。